理中丸除温中补虚外，还具有的功用是
A. 和中缓急
B. 降逆止呕
C. 降逆止痛
D. 养血通脉
E. 补气健脾

正确答案：E。补气健脾

解析：本题考查理中丸的功用。理中丸具有温中祛寒，补气健脾（E对）的功用。可用于治疗脾胃虚寒证，阳虚失血证，脾胃虚寒所致的痹痛；或病后多涎唾；或小儿慢惊等。和中缓急没有在理中丸功用中出现（A错）。降逆止呕没有在理中丸功用中出现（B错）。降逆止痛没有在理中丸功用中出现（C错）。养血通脉没有在理中丸功用中出现（D错）。记忆：理中丸主温中阳，甘草人参主干姜，少阴吐利阴寒痛，或加附子更温阳。